多适用于牙周夹板的卡环
A. 倒钩卡环
B. 三臂卡环
C. 连续卡环
D. 联合卡环
E. 对半卡环

正确答案：C。连续卡环

解析：连续卡环：多用于牙周夹板，放置在两个以上的余留牙上。掌握“局部义齿固位体”知识点。